下列属于胆碱酯酶复活药的是
A. 马拉硫磷
B. 对硫磷
C. 内吸磷
D. 双复磷
E. 对氧磷

正确答案：D。双复磷

解析：胆碱酯酶复活药是一类能使已被有机磷酸酯类抑制的AchE恢复活性的药物，常用的有氯解磷定、碘解磷定和双复磷（D对），以氯解磷定为首选药。